内脏大、小神经含有
A. 腹腔丛发出纤维
B. 交感神经节前纤维
C. 交感神经节后纤维
D. 副交感神经节前纤维
E. 副交感神经节后纤维

正确答案：B。交感神经节前纤维

解析：内脏大神经由穿过第5或第6-9胸交感干神经节的节前纤维组成，内脏小神经,由穿过第10-12胸交感干神经节的节前纤维组成（B对）。